下列关于t分布与正态分布的关系，正确的是
A. 均以0为中心，左右对称
B. 总体均数增大，曲线变得瘦长
C. 曲线下两端5％的面积对应的分位点为±1.96
D. 随样本含量增大，t分布逼近标准正态分布
E. 样本含量无限增大，两者分布完全一致

正确答案：D。随样本含量增大，t分布逼近标准正态分布

解析：（教材99，149页）t分布以0为中心左右对称，正态分布以μ为对称轴左右对称，A错；（教材99页）总体均数决定正态分布峰值位置，故增大时只有曲线的水平位置发生改变！曲线形态不变，B错；曲线下两端百分之五的面积对应位点是μ ±1.96，C错；（教材149页）样本含量无限增大时t分布逐渐接近正态分布！D对，E错。